关于筛检一般不要求具备的特点是
A. 灵敏度高
B. 简便、快速
C. 经济
D. 准确、权威
E. 安全

正确答案：D。准确、权威

解析：本题考查筛检要求具备的特点。一项好的筛检试验应具备良好的真实性（A对）、可靠性和预测度，此外，还应具有的特点包括简单性、（B对）、廉价性（C对）、安全性（E对）和可接受性。关于筛检一般不要求具备的特点是准确、权威（D错，为本题正确答案）。